男，17岁。双耳聋4年。诉出生后至2岁时听力、说话正常。12岁时因患急性扁桃体炎，在当地医疗机构接受庆大霉素治疗。此后，患者听力逐渐下降至完全不能与人交流。该患者最可能的诊断是
A. 药物性耳聋
B. 突发性耳聋
C. 遗传性耳聋
D. 感染性耳聋
E. 功能性耳聋

正确答案：A。药物性耳聋

解析：本题考查氨基苷类抗生素药物的不良反应。男，17岁。双耳聋4年。诉出生后至2岁时听力、说话正常（C错）。12岁时因患急性扁桃体炎，在当地医疗机构接受庆大霉素（氨基苷类抗生素）治疗。此后，患者听力逐渐下降至完全不能与人交流。该患者最可能的诊断是药物性耳聋（A对）。庆大霉素为氨基苷类抗生素，氨基苷类的主要不良反应是耳毒性和肾毒性，尤其在儿童和老人更易引起。毒性产生与服药剂量和疗程有关，也随药物不同而异，甚至在停药以后也可出现不可逆的毒性反应。耳毒性包括前庭神经和耳蜗听神经损伤。突发性耳聋（B错），又称特发性突聋，指在72小时内突然出现的、原因不明的听力下降.患者一般没有耳部传音结构的明显破坏，主要表现为对声音的感受和感觉受损。感染性聋（D错）又称传染性聋，指听觉系统在孕期或出生后受病毒、细菌、立克次体等病原微生物侵袭后，结构和功能受到损害所致的听力下降。常见的病因有风疹、麻疹、梅毒、巨细胞病毒感染、流行性脑膜炎、流行性腮腺炎、伤寒、疟疾、流行性感冒、猩红热等。特别是孕期的感染，还容易导致听觉器官的畸形。功能性耳聋（E错）系指无听觉系统器质性病变的假性听觉障碍，或称心理性聋，癔症性聋，非器质性耳聋，假性神经性聋，假性器质性聋，精神性聋等，为精神心理因素或神经官能症、癔症等所致的精神性耳聋。功能性耳聋也可在原有轻度器质疾患的基础上发生，但患者表现的听觉障碍超过实际听敏度，此类情况也可称之为夸大聋。